影响传染病流行的因素是
A. 自然环境的温度及温度
B. 自然因素和社会因素
C. 社会制度、宗教信仰及地理、气候等
D. 经济条件的好坏
E. 文化水平的高低

正确答案：B。自然因素和社会因素